根据《药品经营质量管理规范》，验证使用的温度传感器最大允许误差为
A. ±2.0℃
B. ±0.5℃
C. ±0.10℃
D. ±1.0℃

正确答案：B。±0.5℃

解析：本题考查的是药品经营质量管理规范的验证管理。验证使用的温度传感器最大允许误差为±0.5℃（B对）。验证使用的温度传感器应当适用被验证设备的测量范围，其最大允许误差为±0.5℃，并经法定计量机构校准，校准证书复印件为验证报告的必要附件。